预防疟疾复发选用的药物是
A. 哌喹
B. 伯氨喹
C. 青蒿素
D. 奎宁
E. 乙胺嘧啶

正确答案：B。伯氨喹

解析：伯氨喹（B对）可杀灭红细胞内疟原虫配子体和肝细胞内迟发型子孢子，防止疟疾的传播与复发。哌喹（A错）和青嵩素（C错）可杀灭红细胞内裂体增殖期疟原虫，控制临床发作（P273）。奎宁（D错）可杀灭红细胞内裂体增殖疟原虫，用于脑型疟疾的治疗（P274）。